外感风寒或风热之邪，或痰湿壅肺，肺失宣肃，导致的音哑或失音，称为
A. 子喑
B. 金破不鸣
C. 金实不鸣
D. 少气
E. 短气

正确答案：C。金实不鸣

解析：本题主要考查中医诊断学闻诊听声音的的内容。